小细胞低色素性贫血可见于
A. 缺铁性贫血
B. 巨幼细胞性贫血
C. 骨髄增生异常综合症
D. 再障
E. 溶血性贫血

正确答案：A。缺铁性贫血

解析：小细胞低色素性贫血的特点是红细胞平均体积＜80fl，红细胞平均血红蛋白＜27pg，红细胞平均血红蛋白浓度＜32%；常见疾病有：缺铁性贫血（A对）、珠蛋白生成障碍性贫血、铁粒幼细胞性贫血等。巨幼细胞性贫血（B错）和骨髄增生异常综合征（C错）呈大细胞性贫血；再障（D错）和溶血性贫血（E错）呈正常细胞性贫血。